男，38岁，反复肾绞痛3年，经常排出小结石，呈黄色，尿路X线平片检查未见显影，结石的性质最可能是
A. 磷酸结石
B. 草酸结石
C. 尿酸结石
D. 磷酸镁铵结石
E. 混合结石

正确答案：C。尿酸结石

解析：男，38岁，反复肾绞痛3年，经常排出小结石，呈黄色（尿酸结石表现），考虑诊断为尿路结石，而尿路X线平片检查未见显影（尿酸结石征象），故结石的性质最可能是尿酸结石（C对）。磷酸结石、磷酸镁铵结石常呈鹿角形，灰白色、黄色或棕色，尿路平片可见分层现象（AD错）。草酸结石不规则，呈桑甚样，棕褐色，尿路平片易显影（B错）。混合结石一般尿路平片可显影（E错）。